生产健美类化妆品需进行
A. 多次皮肤刺激试验
B. 斑贴试验
C. 急性皮肤刺激试验
D. 人体试用试验
E. 功效试验

正确答案：D。人体试用试验

解析：本题考查生产健美类化妆品需进行的试验。人体安全性和功效评价检验方法规定了化妆品安全性和功效评价的人体检验的项目和要求。生产健美类、美乳类、育发类和脱毛类化妆品都需进行人体试用试验（D对E错）。斑贴试验（B错）适用于防晒类、祛斑类和除臭类化妆品的检验。多次皮肤刺激试验（A错）适用于每天使用的化妆品检验。急性皮肤刺激试验（C错）适用于间隔数日使用和用后冲洗的化妆品检验。